不适合普萘洛尔治疗的疾病是
A. 心律失常
B. 心绞痛
C. 支气管哮喘
D. 甲状腺功能亢进
E. 高血压

正确答案：C。支气管哮喘

解析：主要用于治疗心律失常、心绞痛、高血压、甲状腺功能亢进等。掌握“β肾上腺素受体阻断剂”知识点。